患者，男，70岁。患咳喘病多年，近来加重，现症见：咳喘，心悸怔忡，不能平卧，动则尤甚，腹部胀满，浮肿，肢冷尿少，面青唇绀，舌胖紫黯，苔白滑，脉沉细结代。其治疗应首选的方剂是
A. 涤痰汤
B. 独参汤
C. 补肺汤合参蛤散
D. 二陈汤合三子养亲汤
E. 真武汤合五苓散

正确答案：E。真武汤合五苓散

解析：患者有多年咳喘病史，现在因咳喘为主诉，符合中医喘病范畴，心悸，腹部胀满，肢冷尿少，浮肿，舌胖紫黯，苔白滑，为阳虚不能温化水饮所致，诊断为喘证阳虚水泛证，治疗应用真武汤合五苓散（E对）。涤痰汤主治痰蒙神窍证症见神志恍惚，谵语，烦躁不安，撮空理线，表情淡漠，嗜睡，昏迷，苔白腻或淡黄腻，或淡紫，脉细滑数（A错）。独参汤为单味药代表方，主治大量出血；或病至末期，症见面色苍白，神情淡漠，自汗如珠，心悸心慌，呼吸微弱，脉微欲绝（B错）。补肺汤合参蛤散主治呼吸浅短难续，声低气怯，甚则张口抬肩，倚息不能平卧等肺肾虚衰不能纳气等症状（C错）。二陈汤合三子养亲汤治疗痰浊阻肺导致的喘息胸闷，痰多黏腻色白，咯吐不利，舌苔白腻，脉滑（D错）。